在下列各项中，属于医学伦理学基本原则之一的是
A. 互助
B. 诚实
C. 公正
D. 互信
E. 团结

正确答案：C。公正